可以引起阻塞性黄疸并发症的药品是
A. 特布他林
B. 甲氨蝶呤
C. 依托红霉素
D. 骨化三醇
E. 葡萄糖酸钙

正确答案：C。依托红霉素

解析：本题考查妊娠期用药。妊娠后期应用依托红霉素（C对）引起阻塞性黄疸并发症的可能性增加。